适宜通风干燥的是
A. 荆芥
B. 白芍
C. 莱菔子
D. 熟地黄

正确答案：D。熟地黄

解析：本题考查熟地黄的贮藏养护。适宜通风干燥的是熟地黄（D对）。熟地黄【贮藏养护】置阴凉通风干燥处。荆芥（A错）【贮藏养护】置阴凉干燥处。白芍（B错）【贮藏养护】置通风干燥处。防蛀。莱菔子（C错）【贮藏养护】置通风干燥处，防蛀。薏苡仁（E错）【贮藏养护】置通风干燥处，防蛀。